具有降逆止呕功效的是
A. 肉桂
B. 干姜
C. 吴茱萸
D. 小茴香
E. 花椒

正确答案：C。吴茱萸

解析：以上五个选项均属于温里药。吴茱萸辛、苦，热；有小毒；入肝、脾、胃、肾经。可散寒止痛，降逆止呕（C对），助阳止泻。可用于治疗厥阳头痛，寒疝腹痛，寒湿脚气，经行腹痛；脘腹胀痛，呕吐吞酸；五更泄泻等。肉桂辛、甘，大热；入归肾、脾、心、肝经。可补火助阳，益阳消阴，作用温和持久，为治命门火衰之要药；辛热散寒以止痛，善去痼冷沉寒；辛散温通，能行气血，通经脉，散寒止痛（A错）。干姜辛，热；入脾、胃、肾、心、肺经。主入脾胃而长于温中散寒、健运脾阳，‘治感寒腹痛’，为温暖中焦之主药；有温阳守中，回阳通脉的功效；善于温肺散寒化饮（B错）。小茴香辛，温；入肝、肾、、脾、胃经。可温肾暖肝乡散寒止痛；善理脾胃之气而开胃、止呕（D错）。花椒辛、温；入脾、胃、肾经。长于温中燥湿，散寒止痛，止呕止泻；有驱蛔杀虫之功；外用有杀虫止痒之功（E错）。